最早定居到获得性膜上的细菌是
A. 血链球菌
B. 轻链球菌
C. 变形链球菌
D. 乳杆菌
E. 放线菌

正确答案：A。血链球菌

解析：血链球菌是最早定居在牙面的细菌之一。掌握“龋病概述”知识点。